T细胞表面的特有标志是
A. CD4
B. CD32
C. CD8
D. CD28
E. TCR

正确答案：E。TCR

解析：TCR是T细胞表面的特有标志。掌握“B淋巴细胞”知识点。